常用抗幽门螺杆菌的药物是
A. 克拉霉素
B. 青霉素
C. 氯霉素
D. 红霉素
E. 先锋霉素

正确答案：A。克拉霉素

解析：克拉霉素（A对）对革兰阳性菌、嗜肺军团菌、肺炎衣原体的作用为该类最强，对沙眼衣原体、流感杆菌及厌氧菌的作用亦强于红霉素，与奥美拉唑合用对幽门螺旋杆菌有效。青霉素（B错）抗菌作用强，临床可用于治疗敏感的革兰阳性球菌感染、杆菌、革兰阴性球菌、螺旋体所致的感染，不常用于抗幽门螺杆菌。氯霉素（C错）对造血系统具有毒性，一般不作为首选药物，可用于伤寒、立克次体感染、流感嗜血杆菌感染等。红霉素（D错）主要用于对青霉素过敏的金黄色葡萄球菌，对军团菌、弯曲杆菌、支原体肺炎、沙眼衣原体所致的婴儿肺炎和结膜炎可作为首选药。第一代头孢菌素如头孢氨苄、头孢唑林又称为先锋霉素（E错），对革兰阳性菌作用强，对革兰阴性菌作用弱，不耐酶。